随着时间变化，声压波动小于（）的称为稳态噪声
A. 1dB
B. 2dB
C. 3dB
D. 10dB

正确答案：C。3dB

解析：本题考查生产性噪声的概念。根据生产性噪声随时间的分布情况，可分为连续声和间断声。连续声又可分为稳态噪声和非稳态声。随着时间的变化，声压波动＜3dB（C对ABD错）的噪声称为稳态噪声，声压波动≥3dB则为非稳态声。还有一类噪声被称之为脉冲噪声，即声音持续时间≤0.5秒，间隔时间＞l秒，声压有效值变化＞40dB的噪声。